对依托咪酯描述正确的是
A. 药用外消旋体
B. 药用R构型的左旋体
C. 药用S构型的右旋体
D. 药用R构型的右旋体
E. 药用S构型的左旋体

正确答案：D。药用R构型的右旋体